采用非水溶液滴定法测定盐酸氯丙嗪含量时，应选用的器具包括
A. 分析天平
B. 滴定管
C. 高温电炉
D. 坩埚
E. 比色皿

正确答案：A、B。分析天平；滴定管

解析：本题考查非水溶液滴定法所用器具。精密称定药品用分析天平（A对），滴定时要用滴定管（B对）。